既解表散热，又疏肝和胃的中成药是
A. 参苏片
B. 小柴胡片
C. 板蓝根片
D. 三金感冒片
E. 加味银翘片

正确答案：B。小柴胡片

解析：本题考查的是小柴胡片的功能。既解表散热，又疏肝和胃的中成药是小柴胡片（B对）。小柴胡颗粒：【功能】解表散热，疏肝和胃。参苏片（A错）：【功能】益气解表，疏风散寒，祛痰止咳。板蓝根片（C错）：【功能】清热解毒，凉血利咽。三金感冒片（D错）与加味银翘片（E错）的功能，2022年考试指南未明确说明。